坐骨神经出骨盆处的体表投影为
A. 髂后上棘与坐骨结节连线的中点
B. 髂后上棘与坐骨结节连线的上、中1／3
C. 股骨大转子与坐骨结节连线中点
D. 股骨大转子与坐骨结节连线的上、中1／3
E. 肌皮神经

正确答案：B。髂后上棘与坐骨结节连线的上、中1／3

解析：从坐骨结节与大转子连线的中点开始，向下至股骨内、外侧髁连线的中点作一直线，此两点间连线的上2/3段即为坐骨神经在股后区的投影线，出骨盆处的体表投影为髂后上棘与坐骨结节连线的上、中1／3（B对）。